社会医学重视下列哪些因素对人群健康及疾病的影响
A. 生物因素
B. 遗传因素
C. 社会因素
D. 以上都是
E. 以上都不是

正确答案：C。社会因素